男性，28岁，因车祸颌面部外伤8小时后急诊。检查：患者左面部肿胀明显，眶周眼睑及结膜下淤斑、压痛，张口受限，张口度半指，咬合关系正常。X线检查应拍摄
A. 头颅正位片
B. 头颅侧位片
C. 颅底片
D. 下颌曲面体层片
E. 鼻颏位和颧弓切线位

正确答案：E。鼻颏位和颧弓切线位

解析：X线片检查常用鼻颏位（华氏位）和颧弓切线位。可见到颧骨和颧弓的骨折线及移位情况，还可观察到眼眶、上颌窦及眶下孔等结构有无异常，颧弓骨折X线特征性表现呈“M”或“V”形。必要时可拍摄CT进一步明确诊断。近年来三维CT重建更有利于诊断。掌握“颧骨及颧弓、眼眶骨折及骨折愈合过程”知识点。